在中药注射剂中，既可以用作抑菌剂，又可以用作止痛剂的附加剂是
A. 三氯叔丁醇
B. 苯酚
C. 甲酚
D. 甲酸
E. 硫柳汞

正确答案：A。三氯叔丁醇

解析：本题考查的是注射剂的抑菌剂及止痛剂。在中药注射剂中，既可以用作抑菌剂，又可以用作止痛剂的附加剂是三氯叔丁醇（A对）。注射剂的抑菌剂：多剂量包装的注射液可加适宜的抑菌剂。抑菌剂的用量应能抑制注射液中微生物的生长，在制剂确定处方时，该处方的抑菌效力应符合《中国药典》抑菌效率检查法的规定。常用抑菌剂为0.5%苯酚（B错）、0.3%甲酚（C错）、0.5%三氯叔丁醇、0.01%硫柳汞（E错）等。注射剂的止痛剂：为减轻注射时的疼痛而加入的附加剂称为止痛剂，一般用于肌内或皮下注射的注射剂。常用的止痛剂有三氯叔丁醇、盐酸普鲁卡因、盐酸利多卡因等。甲酸（D错）用作注射剂附加剂的作用，2022年考试指南未明确说明。